女，62岁。突然头痛、恶心、伴呕吐，左侧肢体运动障碍3小时。头颅CT示右侧额叶高密度灶。最可能的诊断是
A. 脑出血
B. 短暂性脑缺血发作
C. 颅内肿瘤
D. 脑血栓形成
E. 脑栓塞

正确答案：A。脑出血

解析：中老年女性患者，突发头痛、恶心、伴呕吐（颅内压增高的症状），左侧肢体运动障碍3小时（运动神经元受损症状）。头颅CT示右侧额叶高密度灶（提示脑出血可能性大）。最可能的诊断是脑出血（A对）（P189）。脑栓塞（E错）（P184）及脑血栓形成（D错）（P176）为脑梗死的两种类型，而急性脑梗死24小时内多在CT上无明显改变。短暂性脑缺血发作（TIA）（B错）是由于局部脑或视网膜缺血引起的短暂性神经功能缺损，临床症状一般不超过1小时，且CT无影像学改变（P172）。颅内肿瘤（C错）CT表现多为低密度灶或复杂密度病灶。